与乳突窦相邻
A. 上壁分隔鼓室与颅中窝
B. 下壁颈静脉壁
C. 鼓室前壁
D. 鼓室后壁
E. 鼓室内侧壁

正确答案：D。鼓室后壁

解析：鼓室前壁（C错）也称颈动脉壁，借骨板分隔鼓室与颈内动脉。上壁又称盖壁（A错），分隔鼓室与颅中窝。下壁亦称颈静脉壁，分隔鼓室与颈静脉窝内的颈静脉球（B错）。鼓室后壁（D对）为乳突壁，上部有乳突窦的入口，鼓室借此连通乳突内的乳突小房。内侧壁又称迷路壁（E错），与内耳相隔。